可出现幻觉妄想症状的是
A. 癔症
B. 脑外伤
C. 疑病症
D. 神经衰弱
E. 抑郁症

正确答案：E。抑郁症

解析：抑郁发作以显著而持久的情感低落为主要表现，伴有兴趣缺乏、快感缺失、自杀观念和行为等，可出现幻觉和妄想症状（E对）。神经衰弱的患者长期处于紧张和压力下，出现精神易兴奋和脑力易疲乏，常伴有情绪烦恼、易激惹、睡眠障碍、肌肉紧张性疼痛等，无幻觉妄想症状（D错）。